女，35岁。头晕3年，夜尿增多1年。查体：BP180/110mmHg，无特殊体貌。实验室检查：血钾2.8mmo/L，血肾素活性和血管紧张素降低，醛固酮水平增高。CT示右肾上腺1.0cm椭圆形低密度占位。诊断首先考虑
A. 肾上腺转移瘤
B. 垂体微腺瘤
C. 醛固酮瘤
D. 库欣综合征
E. 嗜铬细胞瘤

正确答案：C。醛固酮瘤

解析：患者头晕，夜尿增多，血压高，低血钾，血肾素活性和血管紧张素降低，醛固酮水平增高。CT示右肾上腺1.0cm椭圆形低密度占位。诊断首先考虑醛固酮瘤（C对）。库欣综合征（D错）：有向心性肥胖、满月脸、多血质特殊体貌。嗜铬细胞瘤（E错）：发作时血压骤升，收缩压可达200-300mmHg，舒张压亦明显升高，可达130-180mmHg，血肾素、醛固酮水平增高。垂体微腺瘤（B错）：有头痛、视力异常的肿瘤占位效应和局部压迫症状。